服用辛伐他汀期间不宜食用的是
A. 绿叶蔬菜
B. 咖啡
C. 葡萄柚汁
D. 奶制品
E. 深海鱼油

正确答案：C。葡萄柚汁

解析：本题考查药物相互作用。服用辛伐他汀期间不宜食用的是葡萄柚汁（C对）。葡萄柚汁主要影响CYP3A4代谢并抑制CYP3A4的活性。辛伐他汀经过CYP3A4代谢而产生活性，与葡萄柚汁同服会引起血药浓度升高。长期服用皮质激素，宜多食高蛋白食物如奶制品（D错）。咖啡因易与人体内游离的钙结合，结合物随尿液排出体外，长期大量饮用咖啡（B错）易致缺钙，诱发骨质疏松症。